可复性关节盘前移位表现为
A. 开口初、闭口末清脆单声弹响
B. 开口末、闭口初清脆单声弹响
C. 最大开口位关节弹响
D. 连续摩擦音或多声破碎音
E. 一般无弹响

正确答案：A。开口初、闭口末清脆单声弹响

解析：可复性关节盘前移位表现：本病的机制是在正中（牙合）位时，关节盘后带的后缘前于髁状突横嵴。在作开口运动时，髁状突的横嵴撞击关节盘后带的后缘时，迅速向前下继而向前上运动，同时关节盘向后方反跳，从而使髁状突由关节盘后带的后缘到达关节盘中间带的下面，恢复正常的髁状突-关节盘的位置关系。因此称为可复性关节盘前移位。在此极为短暂的过程中，发生开口初期的弹响。随着关节盘前移的程度加重，开口初期的弹响可发展为开口中期以及开口末期的弹响。开口型由弹响发生前偏向患侧，弹响发生后又回到中线。有的病人还可以出现往返性弹响，即开口初和闭口末的弹响。不过闭口过程中出现的弹响的强度小于开口时的。本病除了弹响和开口型异常外，在关节的功能区有压痛。X线片可见有关节间隙改变。造影片可见关节盘前移位。本病常伴发翼外肌痉挛和滑膜炎。掌握“颞下颌关节紊乱”知识点。